有系膜的肠管是
A. 十二指肠
B. 升结肠
C. 横结肠
D. 盲肠
E. 直肠

正确答案：C。横结肠

解析：十二指肠(A错)、升结肠(B错)、盲肠(D错)、直肠(E错)均无系膜而横结肠(C对)上有横结肠系膜。